夏季乘凉，外感风寒者，宜选用的药物是
A. 麻黄
B. 香薷
C. 菊花
D. 紫苏
E. 牛蒡子

正确答案：B。香薷

解析：香薷性味辛、微温，归肺脾肾经，具有发汗解表、化湿和中、利水消肿的功效，因其辛温发散，入肺经能发汗解表而散寒，其气芳香，如脾胃又能化湿和中而祛暑，故多用于暑天感受风寒证（B对）。麻黄用于治疗外感风寒表实证、肺气壅遏所致喘咳胸闷、风水水肿（A错）。菊花用于治疗风热感冒，温病初起、肝阳上亢，头痛眩晕、目赤肿痛，眼目昏花、疮痈肿毒（C错）。紫苏治疗风寒表证而兼气滞，胸脘满闷、恶心呕逆，或咳嗽痰多者（D错）。牛蒡子治疗风热感冒，温病初起，咳嗽痰多、麻疹不透，风疹瘙痒、痈肿疮毒，丹毒，痄腮，咽喉肿痛（E错）。